6个月女婴，体重3.6kg，理想体重8kg，每天所需热卡为
A. 初为3MJ/d，以后根据食欲及消化道情况渐增到0.63MJ/（kg·d），待体重接近正常后恢复到生理需要量
B. 初为1.36MJ/d，以后根据食欲及消化道情况渐增到0.5～0.63MJ/（kg·d），待体重接近正常后恢复到生理需要量
C. 2.76MJ/d
D. 初为0.6MJ/d，以后根据食欲及消化道情况渐增到0.63MJ/（kg·d），待体重接近正常后恢复到生理需要量
E. 初为1.25MJ/d，1周后根据食欲及消化道情况渐增到0.63MJ/（kg·d），待体重接近正常后恢复到生理需要量

正确答案：B。初为1.36MJ/d，以后根据食欲及消化道情况渐增到0.5～0.63MJ/（kg·d），待体重接近正常后恢复到生理需要量

解析：本题考查儿童合理营养与膳食的相关概念。该6个月女婴，体重为3.6kg偏低，且理想体重为8kg，因此每天所需热卡初为1.36MJ/d，以后根据食欲及消化道情况渐增到0.5～0.63MJ/（kg·d），待体重接近正常后恢复到生理需要量（B对ACDE错）。